癃闭的病位虽在膀胱，但与本病关系密切的脏腑还有
A. 肺、脾、肾、三焦
B. 肺、肾、胃、三焦
C. 肝、脾、肾、小肠
D. 肺、脾、肝、三焦
E. 肺、脾、肝、小肠

正确答案：A。肺、脾、肾、三焦

解析：小便的通畅虽有赖于肾和膀胱的气化作用，但从脏腑之间的整体关系来看，水液的吸收、运行、排泄，还有赖于三焦的气化和肺、脾、肾的通调、转输、蒸化，因此癃闭的发生，除与肾、膀胱关系密切相关外，还与肺、脾、三焦的关系密切。若肺失肃降，不能通调水道，脾失转输，不能升清降浊，肾失蒸化，关门开合不利，均可导致癃闭的发生，此外，肝郁气滞、瘀血阻塞影响三焦的气化，也可导致癃闭的发生，属于间接影响，关系不如肾密切，此题为单选题，故选A而不选D（A对）（BCDE错）。